生物体内的DNA修复系统主要有
A. 直接修复
B. 重组修复
C. 切除修复
D. SOS修复
E. 以上说法均正确

正确答案：E。以上说法均正确

解析：生物体内的DNA修复系统主要有：直接修复、切除修复、重组修复和SOS修复等。直接修复：光修复系统是直接修复机制之一。光修复过程由光修复酶催化完成。掌握“概述及DNA的生物合成”知识点。